肺总量等于
A. 潮气量﹢肺活量
B. 潮气量﹢功能余气量
C. 余气量﹢补吸气量
D. 余气量﹢肺活量
E. 余气量﹢功能余气量

正确答案：D。余气量﹢肺活量